《中华人民共和国行政处罚法》规定，对当事人可不予行政处罚的情形是
A. 受他人胁迫有违法行为的
B. 主动消除或者减轻违法行为危害后果的
C. 配合行政机关查处违法行为有立功表现的
D. 违法行为轻微并及时纠正，没有造成危害后果的
E. 间歇性精神病人在精神正常时有违法行为的

正确答案：D。违法行为轻微并及时纠正，没有造成危害后果的

解析：本题考察行政处罚。 《中华人民共和国行政处罚法》第二十六条 精神病人在不能辨认或者不能控制自己行为时有违法行为的，不予行政处罚。间歇性精神病人在精神正常时有违法行为的，应当给予行政处罚。第二十七条 当事人有下列情形之一的，应当依法从轻或者减轻行政处罚： (一)主动消除或者减轻违法行为危害后果的； (二)受他人胁迫有违法行为的； (三)配合行政机关查处违法行为有立功表现的； (四)其他依法从轻或者减轻行政处罚的。违法行为轻微并及时纠正，没有造成危害后果的，不予行政处罚（D对）。